血栓形成的条件，不正确的是
A. 血管内皮损伤
B. 新生血小板增多
C. 涡流形成
D. 纤维蛋白溶酶增加
E. 组织因子释放

正确答案：D。纤维蛋白溶酶增加

解析：血栓形成的条件包括：①血管内皮损伤（A对），此为血栓形成最重要和最常见的条件。血管内皮细胞具有抗凝和促凝两种特性，正常情况下，它主要发挥抗凝作用，它可以合成纤溶酶原激活物，致使纤维蛋白溶酶增加（D错，为本题正确答案），促进纤维蛋白溶解以清除沉着于内皮细胞表面的纤维蛋白。而当血管内皮损伤时，内皮下的胶原暴露，激活血小板和凝血因子Ⅻ，从而启动内源性凝血过程；同时损伤的内皮细胞还可释放组织因子（E对），激活凝血因子Ⅶ，启动外源性凝血过程。②凝血因子和新生血小板增多（B对）致使血液凝固性增加。③血流减慢和涡流形成（C对）等血流状态改变。